关于硝普钠，哪项错误
A. 对小动脉和小静脉有同等的舒张作用
B. 适用于治疗高血压危象和高血压脑病
C. 也可用于治疗难治性心衰
D. 连续应用数日后体内可能有SCN⁻蓄积
E. 降压作用迅速而持久

正确答案：E。降压作用迅速而持久